皮下斑点隐隐稀少，色淡红，压之不褪，伴诸虚症状，此为
A. 阳斑
B. 阴斑
C. 麻疹
D. 风疹
E. 癮疹

正确答案：B。阴斑

解析：阴斑常因内伤气虚，气不摄血所致，表现为斑点大小不一，色淡红或紫暗，隐隐稀少，发无定处，出没无常（B对）。阳斑（A错）表现为斑点成片，或红或紫，平铺皮下。麻疹（C错）表现为出疹前先有发热恶寒，咳嗽喷嚏，鼻流清涕，眼泪汪汪，耳根冰冷，或耳后有红丝出现，3～4日疹点出现于皮肤，从头面到胸腹四肢，色如桃红，形如麻粒，尖而稀疏，抚之触手，逐渐稠密，2～5日出全，然后按出疹顺序逐渐回隐，留下棕褐色斑状色素沉着，并有糠麸样脱屑。风疹（D错）初起类似感冒，发热1一2天后，皮肤出现淡红色斑丘疹，瘙痒不已，耳后及枕部臀核肿大为其特征。因皮疹细小如沙，故又称“风痧”。癮疹（E错）表现为皮肤突然出现大小不等、形状不一、边界清楚的红色或苍白色丘疹，并表现出剧烈疹痒，抓挠后增大、增多，发无定处，骤起骤退，退后不留痕迹，反复发作。